治疗脑水肿的首选药是
A. 甘露醇
B. 螺内酯
C. 呋塞米
D. 氯噻嗪
E. 氢氯噻嗪

正确答案：A。甘露醇